抑制细菌DNA依赖的RNA聚合酶发挥作用，口服后尿液呈橘红色的是
A. 异烟肼
B. 盐酸乙胺丁醇
C. 吡嗪酰胺
D. 利福平
E. 对氨基水杨酸钠

正确答案：D。利福平

解析：本题考查利福平。抑制细菌DNA依赖的RNA聚合酶发挥作用，口服后尿液呈橘红色的是利福平（D对）。利福平及其代谢产物均呈橘红色，服药过程中可使痰、尿、唾液、汗液及粪红染，应事先告知服药者。利福平的抗菌作用机制：抑制病原体依赖DNA的RNA聚合酶，与敏感菌依赖DNA的RNA聚合酶β亚单位牢固结合，抑制病原体RNA合成的起始阶段，抑制细菌RNA的合成。异烟肼（A错）的作用机制：异烟肼与菌体的β-酮脂酰载体蛋白合成酶形成复合体，抑制分枝杆菌细胞壁特有的重要成分分枝菌酸的合成，损害了细胞壁的结构完整性和对菌体的屏障保护作用，引起结核分枝杆菌死亡。还可通过抑制结核分枝杆菌的DNA合成或抑制菌体的某些酶，引起菌体代谢紊乱而死亡。盐酸乙胺丁醇（B错）的作用机制：与菌体内Mg²⁺结合，干扰结核分枝杆菌的RNA合成。还能抑制分枝杆菌的阿拉伯糖基转移酶，阻止分枝杆菌细胞壁成分阿拉伯聚糖的聚合反应，影响菌体细胞壁的合成。吡嗪酰胺（C错）的作用机制：抗菌作用机制涉及多个途径和多个靶点，如抑制能量产生、抑制反式翻译及抑制持续生存所需的泛酸盐/辅酶A等。对氨基水杨酸钠（E错）的作用机制：对氨基水杨酸钠为对氨基苯甲酸（PABA）的同类物，通过对叶酸合成的竞争抑制作用而抑制结核分枝杆菌的生长繁殖。